男，40岁，推销员，自述半小时前又突然感到气紧，胸闷，心悸，头晕，出汗，认为生命垂危，被送来急诊。近2月来，这种情况发生过3次，每次持续约0.5～1小时，发病间隙期一切正常，发病与饮食无关。最适宜的急诊处理是
A. 输液补钾
B. 吸入氧气
C. 暗示治疗
D. 安定注射
E. 抗癲痫药

正确答案：D。安定注射

解析：该病例患者突然感到气紧以及认为生命垂危（惊恐发作的临床表现），发作时有胸闷、心悸、头晕，出汗（自主神经症状）。近2月来，反复发作，持续时间半小时左右（存在数次惊恐发作，发作时间一般数分钟至数十分钟），故最可能的诊断为惊恐发作。苯二氮卓类药物（BZD）治疗惊恐发作起效快，故安定（地西泮）（苯二氮卓类药物（BZD））注射为最适宜的处理措施（D对）。惊恐发作的治疗方法包括药物治疗和心理治疗，心理治疗临床上采用认知行为治疗而非暗示治疗，暗示治疗多用于分离（转换）障碍（癔症）（C错）。